女，56岁。子宫内膜癌术后10天。病理示低分化子宫内膜样腺瘤，浸及深肌层，淋巴结无转移，手术病理分期Ⅰb。患者合并高血压，药物控制后血压120～130/70～80mmHg。该患者首选的处理是
A. 中药治疗
B. 生物治疗
C. 放射治疗
D. 随访观察
E. 内分泌治疗

正确答案：C。放射治疗

解析：女，56岁。子宫内膜癌术后10天。病理示低分化子宫内膜样腺癌，浸及深肌层，淋巴结无转移，手术病理分期Ⅰb。患者合并高血压，药物控制后血压120～130/70～80mmHg。据病史及术后病检等，考虑该患者属于子宫内膜癌早期，并由术后病检可知肿瘤肌层浸润超过1/2。患者已行手术治疗，术后应根据肿瘤肌层浸润超过1/2这个高危因素选择辅助治疗。放疗联合手术适用于伴有高危因素的Ⅰ期患者，术后放疗可降低局部复发，改善无瘤生存期，所以该患者首选的处理是放射治疗（C对）。若随访观察（D错），则可导致肿瘤复发，病变进一步进展。内分泌治疗（E错），也就是孕激素治疗，主要用于保留生育功能的早期子宫内膜癌患者。该患者已56岁，不作为首选考虑。中药治疗（A错）、生物治疗（B错）能帮助改善患者病情，但不作为首选治疗。